肠道菌群是定居在
A. 消化道
B. 胃
C. 小肠
D. 胰腺
E. 肝脏

正确答案：A。消化道

解析：肠道菌群是定居在人消化道中菌群的集合。人肠道细菌的种类可达300～1000种。肠道细菌促进肠道黏膜免疫系统的早期发育，促进肠黏膜相关的淋巴组织中的B细胞产生针对病原体的抗体。掌握“细胞因子及受体”知识点。